关于腺病毒所致疾病，哪项错误
A. 病毒性肺炎
B. 流行性角结膜炎
C. 咽结膜热
D. 先天性畸形
E. 婴幼儿胃肠炎

正确答案：D。先天性畸形